输尿管是将肾产生的尿液输送至膀胱的肌性管道，行程较长约20~30cm，在腹膜后下行，入盆腔注入膀胱。在女性与子宫动脉相交叉。关于女性输尿管，何者错误
A. 沿腰大肌前面下行
B. 行经子宫阔韧带的基底部附近的结缔组织内
C. 通过尿生殖膈
D. 行经子宫颈两侧
E. 在膀胱底外上角处，斜穿膀胱壁，开口于膀胱三角的外侧角

正确答案：C。通过尿生殖膈

解析：通过尿生殖膈（C错，为本题正确答案）是女性尿道的特点。女性输尿管腹部沿腰大肌前面下行（A对），盆部行经子宫颈两侧（D对），最后由膀胱底穿入膀胱壁，其开口位于膀胱三角上面的两个角处（E对），在与子宫动脉相交叉时，输尿管行经子宫阔韧带的基底部附近的结缔组织内（B对）。